呈酸性状态，对活髓牙有刺激作用的材料
A. 磷酸锌粘固剂
B. 树脂类粘固剂
C. 聚羧酸粘固剂
D. 玻璃离子粘固剂
E. 氧化锌丁香油粘固剂

正确答案：A。磷酸锌粘固剂

解析：磷酸锌粘固剂：具有较高的抗压强度，粘固力强。粘固时pH为3.5，由于这一酸性状态，对牙髓有刺激作用，活髓牙不宜使用。掌握“修复体试戴、磨光与粘固”知识点。